断裂
A. 染色体的非染色带无线状连接
B. 染色体的非染色带有线状连接
C. 光镜下不可见的DNA缺失
D. 远离原位的染色体断裂节段
E. 有染色质缺失的染色体

正确答案：A。染色体的非染色带无线状连接

解析：本题考查断裂。断裂是指染色体的非染色带无线状连接（A对BCDE错）。